有关鼻中隔的描述，正确的是
A. 只有犁骨和鼻中隔软骨被覆粘膜而成
B. 由鼻中隔软骨被覆粘膜而成
C. 由筛骨垂直板,梨骨及鼻中隔软骨被覆粘膜而成
D. 与嗅觉无关
E. 以上均不正确

正确答案：C。由筛骨垂直板,梨骨及鼻中隔软骨被覆粘膜而成

解析：鼻中隔由筛骨垂直板、犁骨和鼻中隔软骨组成支架（AB错），表面被覆黏膜而成（C对）。鼻黏膜分两部分，位于上鼻甲和与其相对的鼻中隔以及二者上方鼻腔顶部的区域称嗅区,富含接受嗅觉刺激的嗅细胞（D错）。